不属于经皮给药制剂类型的是
A. 充填封闭型
B. 复合膜型
C. 中空分散型
D. 聚合物骨架型
E. 微储库型

正确答案：C。中空分散型

解析：本题考查经皮给药制剂。不属于经皮给药制剂类型的是中空分散型（C错，为本题正确答案）。经皮给药制剂包括膜控释型和骨架型两类，包括：充填封闭型（A对）、复合膜型（B对）、黏胶分散型、聚合物骨架型（D对）、微储库型（E对）。